无铰链区的免疫球蛋白是
A. IgG、IgD
B. IgA、IgG
C. IgG、IgE
D. IgM、IgE
E. IgM、IgD

正确答案：D。IgM、IgE